损伤副神经可致
A. 胸锁乳突肌瘫痪，斜方肌正常
B. 伤侧肩下垂，面转向伤侧
C. 伤侧肩下垂，面转向健侧
D. 健侧肩下垂，面转向伤侧
E. 健侧肩下垂，面转向健侧

正确答案：B。伤侧肩下垂，面转向伤侧

解析：一侧副神经支配同侧胸锁乳突肌和斜方肌，因而损伤副神经可使同侧胸锁乳突肌和斜方肌瘫痪，表现为伤侧肩下垂，面转向伤侧（B对）。